社会上和医学实践中争议较大的是
A. 临终关怀
B. 主动安乐死
C. 被动安乐死
D. 自愿安乐死
E. 非自愿安乐死

正确答案：B。主动安乐死

解析：本题考查安乐死的伦理争议。社会上和医学实践中争议较大的是主动安乐死（B对），因虽然得到许多人的赞同，但目前在大多数国家的法律中仍属于故意杀人行为，会构成犯罪，在伦理上也存在着巨大的争议。临终关怀（A错）是指一种新兴的医疗保健服务项目，是由多学科、多方面人员组成的团队，对临终病人及其家属提供全面照护，以便使临终病人得以舒适、安宁地度过人生最后的旅程。被动安乐死（C错），则争议最小，因在临床实践中，自愿放弃无望的抢救或治疗的现象虽显得万般无奈，但似乎已成为某种常态。自愿安乐死（D错）指在安乐死对象自愿要求的条件下对其实施的安乐死。非自愿安乐死（E错）安乐死对象在非自愿或并未明确表示自愿选择的条件下被实施的安乐死，凡属非自愿类型的，都是有问题的。